《中华人民共和国药品管理法》规定，颁发药品注册证书的部门是
A. 国务院药品监督管理部门
B. 国务院卫生行政部门
C. 国务院科技管理部门
D. 国务院经济综合主管部门
E. 国务院药品监督管理部门、国务院卫生行政部门

正确答案：A。国务院药品监督管理部门

解析：本题考查药品研制和注册。《中华人民共和国药品管理法》规定，颁发药品注册证书的部门是国务院药品监督管理部门（A对）。《中华人民共和国药品管理法》《中华人民共和国药品管理法》第二章药品研制和注册第二十四条：在中国境内上市的药品，应当经国务院药品监督管理部门批准，取得药品注册证书；但是，未实施审批管理的中药材和中药饮片除外。实施审批管理的中药材、中药饮片品种目录由国务院药品监督管理部门会同国务院中医药主管部门制定。申请药品注册，应当提供真实、充分、可靠的数据、资料和样品，证明药品的安全性、有效性和质量可控性。